取粉末少量加清水调和，涂于指甲上，能“挂甲”的药材是
A. 鹿茸
B. 蟾酥
C. 羚羊角
D. 牛黄
E. 僵蚕

正确答案：D。牛黄

解析：本题考查的是动物类中药的传统经验鉴别方法。取粉末少量加清水调和，涂于指甲上，能“挂甲”的药材是牛黄（D对）。一些传统经验鉴别方法仍是鉴别动物类中药有效而重要的手段：手试法，如毛壳麝香手捏有弹性；麝香仁以水润湿，手搓能成团，轻揉即散，不应粘手、染手、顶指或结块。水试法，熊胆仁投于水杯中，即在水面旋转并呈现黄线下降而不扩散；牛黄水液可使指甲染黄，习称“挂甲”；火试法，如麝香仁撒于炽热坩埚中灼烧，初则迸裂，随即熔化膨胀起泡，浓香四溢，灰化后呈白色灰烬，无毛、肉焦臭，无火焰或火星；马宝粉末置于锡箔纸上加热，其粉末聚集，并发出马尿臭等。鹿茸（A错）：【性状鉴别】药材花鹿茸呈圆柱状分枝，具1个分枝者习称“二杠”，主枝习称“大挺”，离锯口约1cm处分出侧枝，习称“门庄”，直径较大挺略细。外皮红棕色或棕色，多光润，表面密生红黄色或棕黄色细茸毛，上端毛密，下端较疏，分岔间具1条灰黑色筋脉，皮茸紧贴。锯口面黄白色，外围无骨质，中部密布细孔。具两个分枝者，习称“三岔”，大挺直径较二杠细，略呈弓形，微扁，枝端略尖，下部有纵棱筋及突起小疙瘩；皮红黄色，茸毛较稀且粗。体轻。气微腥，味微咸。蟾酥（B错）：【性状鉴别】药材呈扁圆形团块状或片状。棕褐色或红棕色。团块状者质坚，不易折断，断面棕褐色，角质状，微有光泽；片状者质脆，易碎，断面红棕色，半透明。气微腥，味初甜而后有持久的麻辣感，粉末嗅之作嚏。羚羊角（C错）：【性状鉴别】药材呈长圆锥形，略呈弓形弯曲。类白色或黄白色，基部稍呈青灰色。嫩枝对光透视有“血丝”或紫黑色斑纹，光润如玉，无裂纹，老枝有细纵裂纹。除顶端部分外，有10～16个隆起环脊，用手握之，四指正好嵌入凹处。角基部横截面类圆形，内有坚硬质重的角柱，习称“骨塞”。除去“骨塞”后，角的下半部呈空洞，全角呈半透明，对光透视，上半段中央有一条隐约可辨的细孔道直通角头，习称“通天眼”。质坚硬，气微，味淡。僵蚕（E错）：【性状鉴别】药材略呈圆柱形，多弯曲皱缩。表面灰黄色，被有白色粉霜状的气生菌丝和分生孢子。头部较圆，足8对，体节明显，尾部略呈二分歧状。质硬而脆，易折断，断面平坦，外层白色，中间有亮棕色或亮黑色丝腺环4个。气微腥，味微咸。